平滑面龋的病损形态是
A. 烧瓶状，口小底大
B. 烧瓶状，口大底小
C. 浅碟状，口大底浅
D. 三角形，顶向釉牙本质界
E. 三角形，顶向釉质表面

正确答案：D。三角形，顶向釉牙本质界

解析：平滑面龋：釉质深层受累，病损呈三角形，三角形的顶部向着釉牙本质界，基底部向着釉质表面，三角形顶部为病变最早、最活跃的部分。掌握“牙釉质龋”知识点。